含下列生物碱的中药酸水提取液，用氯仿萃取，可萃出的生物碱是
A. 苦参碱
B. 氧化苦参碱
C. 秋水仙碱
D. 麻黄碱
E. 山莨菪碱

正确答案：A。苦参碱

解析：本题考查的是游离生物碱的溶解性。含下列生物碱的中药酸水提取液，用氯仿萃取，可萃出的生物碱是苦参碱（A对）。游离生物碱的溶解性：（1）亲脂性生物碱：多数具仲胺和叔胺氮原子的生物碱有较强的脂溶性，易溶于乙醚、苯和卤烃类（二氯甲烷、三氯甲烷、四氯化碳等）等有机溶剂中，尤其在三氯甲烷中溶解度较大；可溶于甲醇、乙醇、丙酮和乙酸乙酯等；不溶或难溶于水，但易溶于酸水。（2）亲水性生物碱：①季铵型生物碱：这类生物碱为离子型化合物，易溶于水和酸水，可溶于甲醇、乙醇及正丁醇等极性较大的有机溶剂，难溶于亲脂性有机溶剂。②含N-氧化物结构的生物碱：这类生物碱具配位键结构，可溶于水，如氧化苦参碱（B错）。③小分子生物碱：少数分子较小而碱性较强的生物碱，既可溶于水，也可溶于三氯甲烷，如麻黄碱（D错）、烟碱等。④酰胺类生物碱：由于酰胺在水中可形成氢键，所以在水中有一定的溶解度，如秋水仙碱（C错）、咖啡碱。（3）具有特殊官能团的生物碱：①具有酚羟基或羧基的生物碱：这类生物碱称为两性生物碱，既可溶于酸水，也可溶于碱水溶液。具有酚羟基的生物碱（常称为酚性生物碱），可溶于氢氧化钠等强碱性溶液，如吗啡；具有羧基的生物碱可溶于碳酸氢钠溶液，如槟榔次碱。②具有内酯或内酰胺结构的生物碱：这类生物碱在正常情况下，其溶解性类似一般叔胺碱，但在强碱性溶液中加热，其内酯（或内酰胺）结构可开环形成羧酸盐而溶于水中，酸化后环合析出。如喜树碱、苦参碱等。某些生物碱溶解性不符合上述规律，如吗啡为酚性生物碱，但难溶于三氯甲烷、乙醚；石蒜碱难溶于有机溶剂，而溶于水；喜树碱不溶于一般有机溶剂，而溶于酸性三氯甲烷等。山莨菪碱（E错）分子中有羟基，能溶于水和乙醇。